我国第五次全国人口普查数据显示，60岁以上人口及65岁以上人口占总人口数的比例分别为
A. 8.5%，6.6%
B. 7.23%，6.8%
C. 8.33%，6.8%
D. 9%，6.9%
E. 10%，6.96%

正确答案：E。10%，6.96%